以下哪种不属于常见牙髓变性的种类
A. 成牙本质细胞空泡变性
B. 牙髓纤维性变
C. 牙髓钙化
D. 牙髓网状萎缩
E. 增生性牙髓炎

正确答案：E。增生性牙髓炎

解析：本题考查牙髓变性。增生性牙髓炎（E错，为本题正确答案）不属于常见牙髓变性的种类。牙髓组织受到长期慢性刺激，或因根尖孔缩窄，牙髓供血不足，使牙髓组织代谢障碍而出现的不同程度和不同类型的退行性变，称牙髓变性。常见的有以下几种：成牙本质细胞空泡变性（A对）、牙髓钙化（C对）、牙髓网状萎缩（D对）、牙髓纤维性变（B对）四种。